男婴，4个月。冬季出生。近2日经常出现面部、四肢抽动，双眼上翻，每次持续数10秒，1日数次，可自然缓解，发作后玩耍如常。体温正常。母孕期有腿部抽筋病史。该患儿最可能的诊断是
A. 低血镁症
B. 维生素D缺乏性手足搐搦症
C. 婴儿痉挛症
D. 甲状旁腺功能减低症
E. 低血糖症

正确答案：B。维生素D缺乏性手足搐搦症

解析：4月冬季出生患儿，有间断性面部四肢抽动和双眼上翻的症状，且可以自然缓解，发作后玩耍如常，符合维生素D缺乏性手足搐搦症的特点，应诊断为维生素D缺乏性手足搐搦症（B对）。低血镁症除有抽动的症状外还常有触觉、听觉过敏的表现（A错）。婴儿痉挛症在痉挛停止后会有神经损伤的后遗症，而该患儿发作后玩耍如常，故不能诊断为婴儿痉挛症（C错）。甲状旁腺功能减低症常表现为肌肉疼痛、僵直、麻木、痉挛、陶色征阳性，与该患儿的表现不符（D错）。低血糖症：常有清晨空腹、进食不足或腹泻的病史，重症病例会惊厥、面色苍白等症状，一般不会自然缓解，需要体外补充葡萄糖才会好转（E错）。